65岁男性，自述耳垂下至下颌角区域无痛性缓慢肿大一年半前来就诊，检查时发现肿块囊性感突出，质地柔软，界限清楚，直径为3.5cm左右，手术时病理切片可见肿瘤上皮细胞形成腺管样或囊腔样结构，且有乳头突入，腔内侧面有嗜伊红颗粒的大嗜酸性粒细胞，则此病可诊断为
A. 嗜酸性腺瘤
B. 腺淋巴瘤
C. 多形性腺瘤
D. 腺样囊性癌
E. 粘液表皮样癌

正确答案：B。腺淋巴瘤

解析：腺淋巴瘤又称为Warthin瘤，肿瘤呈圆形或卵圆形，平均直径2～4cm，质地柔软，可有囊性感。包膜完整，界限清楚。光镜观察，肿瘤由上皮和淋巴样组织构成。肿瘤上皮细胞形成大小和形态不一的腺管或囊腔样结构，有乳头突入囊腔。囊腔内衬上皮由双层细胞构成，腔面细胞胞质内含有嗜伊红颗粒的大嗜酸性粒细胞。掌握“沃辛瘤及嗜酸性腺瘤”知识点。